甲基汞在机体主要作用靶器官是
A. 脑
B. 肝
C. 脾
D. 肾
E. 骨骼

正确答案：A。脑

解析：本题考查甲基汞在机体主要作用靶器官。甲基汞是有机汞中的烷基汞类，进入人体后遍布全身各器官组织中，主要损害神经系统，最严重的是脑组织（A对BCDE错），其损伤是不可逆的。